8月某日，某婚宴有8%用餐者先后因腹痛、腹泻就诊。大部分患者出现上腹和脐周阵发性绞痛，继而腹泻，5～10次／天，粪便呈洗肉水样。调查发现聚径的主要食物为海鲜类食品，引起该食物中毒的病原菌最有可能是
A. 葡萄球菌
B. 副溶血性弧菌
C. 沙门菌
D. 李斯特菌
E. 肉毒梭菌

正确答案：B。副溶血性弧菌

解析：根据题意，某婚宴患者们因食用以海鲜类为主的食物（副溶血性弧菌常见传染源）继发腹痛、腹泻就诊。大部分患者出现上腹和脐周阵发性绞痛，继而腹泻，5～10次／天，粪便呈洗肉水样（为副溶血性弧菌典型中毒症状）。据患者既往史、临床症状，致病菌应为副溶血性弧菌（B对）。沙门菌感染最常见为因患者食用被鼠伤寒沙门菌、猪霍乱沙门菌或肠炎沙门菌所感染的畜、禽肉类食品或蛋类、奶及奶制品所致感染。与本题中患者所用食物不符（C错）。李斯特菌（D错）主要为鲜奶产品中的一种污染物，能引起严重食物中毒成人患者主要表现为败血症、脑膜炎和单核细胞增多。肉毒梭菌（E错）为严格厌氧菌，以神经外毒素致病，患者可因食用被病菌污染的腌制食品或发酵食品而中毒，临床主要表现为弛缓性瘫痪。